造成絮凝的原因是
A. Zeta电位降低
B. 分散相与连续相存在密度差
C. 微生物及光、热、空气等的作用
D. 乳化剂失去乳化作用
E. 乳化剂类型改变

正确答案：A。Zeta电位降低

解析：本题考查乳剂。乳剂中分散相的乳滴发生可逆的聚集现象称为絮凝。发生絮凝的条件是乳滴的电荷减少，使ζ电位降低（A对），乳滴产生聚集而絮凝。分散相与连续相存在密度差（B错）是引起乳剂分层的原因。微生物及光、热、空气等的作用（C错）是引起乳剂酸败的原因。乳化剂失去乳化作用（D错）是引起乳剂破裂的原因。乳化剂类型改变（E错）是引起乳剂转相的原因。